阿托品不良反应为
A. 瞳孔轻度扩大
B. 肠蠕动增加、烦躁不安
C. 调节痉挛、心率加快
D. 肠蠕动减少、唾液分泌增加
E. 中枢抑制、心率减慢

正确答案：A。瞳孔轻度扩大

解析：本题考查阿托品的不良反应。阿托品的常见不良反应有口干、视力模糊、心率加快、瞳孔轻度扩大（A对）及皮肤潮红等。阿托品通过M胆碱受体的阻断作用抑制腺体分泌（D错），故其不良反应包括口干。阿托品可抑制胃肠道平滑肌痉挛，降低蠕动的幅度和频率，缓解胃肠绞痛，故其不良反应包括肠蠕动减少（B错），便秘。治疗剂量的阿托品对中枢神经系统的影响不明显；较大剂量（1～2mg）可轻度兴奋延髓和大脑，5mg时中枢兴奋明显增强（E错），中毒剂量（l0mg以上）可见明显中枢中毒症状；继续增加剂量，可见中枢兴奋转为抑制，发生昏迷与呼吸麻痹，最后死于循环与呼吸衰竭。治疗剂量的阿托品可使部分患者心率短暂性轻度减慢（C错）。